高温烹调加工食品容易产生丙烯酰胺的主要原因是食品中富含
A. 蛋白质
B. 脂肪
C. 淀粉
D. 水
E. 热量

正确答案：C。淀粉

解析：本题考查高温烹调加工食品容易产生丙烯酰胺的主要原因。高温烹调加工食品容易产生丙烯酰胺的主要原因是食品中富含淀粉（C对ABDE错）。